下列关于面侧深区的境界说法中，正确的是
A. 前为上颌骨后面
B. 内为翼外板
C. 外以下颌支
D. 后界腮腺鞘
E. 以上均正确

正确答案：E。以上均正确

解析：面侧深区的境界前为上颌骨后面，后界腮腺鞘，内为翼外板，外以下颌支为界。掌握“面侧深区及颌面部各间隙的境界”知识点。